免疫系统消除病毒感染细胞的主要机制是
A. 诱导免疫抑制
B. 诱导特异性CTL产生
C. 上调IL-10
D. 诱导免疫耐受
E. 下调HLA分子的表达

正确答案：B。诱导特异性CTL产生

解析：CTL可高效、特异性地杀伤胞内病原体（病毒和某些胞内寄生菌）感染细胞、肿瘤细胞等靶细胞，而不损害正常细胞。当有病毒感染时，免疫系统诱导特异性CTL产生（B对），杀伤胞内的病毒。诱导免疫抑制（A错）、诱导免疫耐受（D错）均不是免疫系统消除病毒感染细胞的主要机制。IL-10的功能是抑制活化的单核细胞产生细胞因子，抑制Th1细胞因子的产生，促进B细胞增值，故上调IL-10（C错）不是免疫系统消除病毒感染细胞的主要机制。HLA分子主要介导急性排斥反应，下调HLA分子的表达（E错）不可以消除病毒感染的细胞。